患儿，女，4岁半，身高110cm，体重15kg。一天前开始发热（39.1℃），咽稍痛，无咳嗽，无吐泻，家长在家选用退烧药对症治疗。发病20h左右出现腹泻，约2～3h一次大便，量少，黄色黏液便，呕吐1次。体格检查：T38.8℃，P118次/分，R28次/分，咽微充血，出现轻微脱水症状。双肺呼吸音清，腹平，肝脾未触及，肠鸣音活跃，实验室检查：WBC18.5×10⁹/L（参考值4.0×10⁹～10.0×10⁹/L），粪便镜检可见红、白细胞。该患者腹泻治疗过程中不应选择的药物是
A. 小檗碱
B. 洛哌丁胺
C. 药用炭
D. 鞣酸蛋白
E. 口服补液盐

正确答案：B。洛哌丁胺

解析：本题考查腹泻治疗药物。洛哌丁胺（B错，为本题正确答案）为肠道动力抑制剂，直接作用于肠壁平滑肌，多用于无侵袭性腹泻症状的轻至中度旅行者腹泻，但对于伴发热或明显腹痛的腹泻患者应避免使用。